女，25岁。发热伴下肢和腹部皮肤瘀斑5天。查体：双下肢和腹部皮肤有多处瘀斑，双侧颈部、腋窝和腹股沟可触及淋巴结肿大，活动无压痛，最大者为2.0cm×2.5cm，胸骨压痛（+），腹软，肝肋下1.5cm，脾肋下2cm。化验：Hb78g/L，WBC18×10⁹/L，分类可见原始和幼稚细胞，PLT25×10⁹/L，网织红细胞0.002。该患者最可能的诊断是
A. 急性淋巴细胞白血病
B. 非霍奇金淋巴瘤
C. 急性粒细胞白血病
D. 霍奇金淋巴瘤
E. 系统性红斑狼疮

正确答案：A。急性淋巴细胞白血病

解析：患者青年女性，发热伴下肢和腹部皮肤瘀斑5天，查体：双下肢和腹部皮肤有多处瘀斑（贫血、发热、出血是急性白血病正常骨髓造血功能受抑制的表现），双侧颈部、腋窝和腹股沟可触及淋巴结肿大，胸骨压痛（+），肝脾肿大（白血病细胞增殖浸润可引起肝脾、淋巴结肿大，胸骨压痛，淋巴结肿大以ALL较多见），化验：Hb78g/L（成年女性Hb正常值110～150g/L），WBC18×10⁹/L（正常4～10×l0⁹/L）增多，分类可见原始和幼稚细胞（正常人外周血中不会出现原始细胞），提示急性白血病，PLT25×10⁹/L（正常100～300×l0⁹/L）减少，网织红细胞0.002（正常0.005～0.015）降低，故患者最可能的诊断为急性淋巴细胞白血病（A对）。非霍奇金淋巴瘤（P588）（B错）以淋巴结肿大为特点，临床表现多样，白细胞多正常，常伴有淋巴细胞增多；霍奇金淋巴瘤（P584）（D错）以淋巴结肿大为特点，发热、盗汗、瘙痒及消瘦等全身症状多见，出血不常见，R-S细胞为其诊断性细胞；急性粒细胞白血病（P571）（C错）可伴有粒细胞肉瘤，一般无淋巴结肿大；系统性红斑狼疮（P817）（E错）为多系统损害性自身免疫性疾病，其血液系统表现为血红蛋白下降、白细胞和血小板减少，部分患者可有淋巴结肿大。